罂粟壳有毒，其使用注意有
A. 运动员慎服
B. 孕妇及儿童禁用
C. 咳嗽初起者忌服
D. 泄痢初起者忌服
E. 不宜大量或久服

正确答案：A、B、C、D、E。运动员慎服；孕妇及儿童禁用；咳嗽初起者忌服；泄痢初起者忌服；不宜大量或久服

解析：本题考查的是罂粟壳的使用注意。罂粟壳有毒，其使用注意有运动员慎服（A对）、孕妇及儿童禁用（B对）、咳嗽初起者忌服（C对）、泄痢初起者忌服（D对）与不宜大量或久服（E对）。罂粟壳：【使用注意】本品酸涩收敛，故咳嗽与泻痢初起者忌服。有毒并易成瘾，不宜大量服用或久服。孕妇及儿童禁用。运动员慎服。